循行于上肢外侧中线的是
A. 手太阴肺经
B. 手太阳小肠经
C. 手少阴心经
D. 手厥阴心包经
E. 手少阳三焦经

正确答案：E。手少阳三焦经

解析：本题考查的是十二经脉在四肢部位的分布规律。循行于上肢外侧中线的是少阳三焦经（E对）。十二经脉在四肢部位的分布规律：阴经分布于内侧面，阳经分布于外侧面。内侧分为三阴，外侧分为三阳，前后顺序规律：太阴、阳明在前缘，少阴、太阳在后缘，厥阴、少阳在中线。上肢内侧的经脉分布是手太阴肺经（A错）在前，手厥阴心包经（D错）在中，手少阴心经（C错）在后；上肢外侧的经脉分布是手阳明大肠经在前，手少阳三焦经在中，手太阳小肠经（B错）在后。下肢内侧的经脉分布是内踝上八寸以下，足厥阴肝经在前，足太阴脾经在中，足少阴肾经在后；至内踝八寸以上，则足太阴脾经在前，足厥阴肝经在中，足少阴肾经在后；下肢外侧的经脉分布是，足阳明胃经在前，足少阳胆经在中，足太阳膀胱经在后。